被称为“决渎之官”的是
A. 胆
B. 胃
C. 三焦
D. 小肠
E. 膀胱

正确答案：C。三焦

解析：三焦充填于胃肠道与膀胱之间，引导胃肠中水液渗入膀胱，是水液下输膀胱之通路。三焦水道通畅，则胃肠中的水液源源不断渗入膀胱，成为尿液生成之源。所以说“三焦者，决渎之官（C对），水道出焉。”《素问·灵兰秘典论》说：“ 心者，君主之官也，神明出焉。肺者，相傅之官，治节出焉。肝者，将军之官，谋虑出焉。胆者，中正之官（A错），决断出焉。膻中者，臣使之官，喜乐出焉。脾胃者，仓廪之官（B错），五味出焉。大肠者，传道之官，变化出焉。小肠者，受盛之官（D错），化物出焉。肾者，作强之官，技巧出焉。三焦者，决渎之官，水道出焉。膀胱者，州都之官（E错），津液藏焉，气化则能出矣。”